细胞外液渗透压至少有多少变动才会影响体内抗利尿激素(ADH)释放
A. 1%~2%
B. 3%~4%
C. 5%~6%
D. 7%~8%
E. 9%~10%

正确答案：A。1%~2%

解析：ADH的作用是促进远曲肾小管和集合管对钠水的重吸收，是引起钠水潴留的重要原因之一。当体内水分过少或摄盐过多引起细胞外渗透压增高时，可使ADH释放增加，减少排尿。细胞外液渗透压有1% -2%（A对）变动时，就会使抗利尿激素（ADH）的释放增加。